抗菌药物可覆盖毛霉菌素的吡咯类抗真菌药物是
A. 克霉唑
B. 泊沙康唑
C. 伏立康唑
D. 伊白康唑
E. 氟康唑

正确答案：B。泊沙康唑

解析：本题考查吡咯类抗真菌药物。吡咯类抗真菌药物包括咪唑类和三唑类，其中三唑类抗真菌药泊沙康唑（B对）和艾沙康唑能够覆盖毛霉菌属。